小茴香善于治疗的是
A. 亡阳厥逆
B. 厥阴头痛
C. 寒饮咳喘
D. 虚阳上浮
E. 寒疝腹痛

正确答案：E。寒疝腹痛

解析：该题考查小茴香的主治病证。小茴香有散寒止痛，理气和胃的功效。本品辛温，能温肾暖肝，散寒止痛，可治寒疝腹痛及肝郁气滞，睾丸偏坠胀痛，亦可治肝经受寒引起的少腹冷痛或冲任虚寒引起的痛经（ABCD错E对）。